评价混悬剂质量的参数是
A. 波动度
B. 相对生物利用度
C. 绝对生物利用度
D. 脆碎度
E. 絮凝度

正确答案：E。絮凝度

解析：本题考查混悬剂。絮凝度（E对）是评价混悬剂质量的参数，絮凝效果越好，混悬剂的稳定性越好；波动度（A错）是评价血药浓度波动程度的方法；相对生物利用度（B错）是试验制剂与参比制剂的AUC之比；绝对生物利用度（C错）是参比制剂的AUC与静脉注射给药的AUC之比；脆碎度（D错）是评价片剂抗磨损和抗振动能力的参数。